在常温下，机体散热的主要机制是
A. 辐射
B. 蒸发
C. 出汗
D. 不感蒸发
E. 传导

正确答案：A。辐射